患者女，56岁，既往有高血压、高脂血症病史，长期服用依那普利片、阿托伐他汀钙片。现因上腹痛2周，伴黑便数日就诊。患者自诉3周前因膝关节痛，服用布洛芬，疼痛未缓解，自行加用萘普生。胃镜检查显示胃窦小弯侧有一约7mm溃疡，幽门螺杆菌(Hp）阳性。肾功能未见异常。该患者根除Hp的推荐用药方案是
A. 埃索美拉唑(艾司奥美拉唑）+阿莫西林+克拉霉素
B. 埃索美拉唑(艾司奥美拉唑）+枸橼酸铋钾+阿莫西林+甲硝唑
C. 埃索美拉唑(艾司奥美拉唑）+枸橼酸铋钾+阿莫西林+克拉霉素
D. 埃索美拉唑(艾司奥美拉唑）+枸橼酸铋钾+克拉霉素+左氧氟沙星
E. 埃索美拉唑(艾司奥美拉唑） +枸橼酸铋钾+克拉霉素+甲硝唑

正确答案：B。埃索美拉唑(艾司奥美拉唑）+枸橼酸铋钾+阿莫西林+甲硝唑

解析：本题考查幽门螺杆菌感染方案。该患者根除Hp的推荐用药方案是埃索美拉唑(艾司奥美拉唑）+枸橼酸铋钾+阿莫西林+甲硝唑（B对）。根除幽门螺杆菌感染的一线方案是PPI(艾司奥美拉唑）+克拉霉素+阿莫西林+铋剂7～14d或者PPI(艾司奥美拉唑）+克拉霉素+甲硝唑+铋剂7～14d。因为患者正在服用他汀类药物，克拉霉素为肝药酶抑制剂，会加重他汀类药物肌毒性，故推荐用药方案中不能含有克拉霉素（ACDE错）。